26岁初孕妇，现妊娠40周，近半月头痛、眼花，今晨出现剧烈头痛并呕吐2次来院就诊。测血压180/110mmHg。为与慢性高血压鉴别，最有价值的血液检查结果是
A. 尿素氮值增高
B. 尿素值增高
C. 尿酸值增高
D. 肌酸值增高
E. 肌酐值增高

正确答案：C。尿酸值增高

解析：26岁初孕妇，妊娠40周，出现头痛、眼花、呕吐（重度子痫前期可有持续头痛或视觉障碍或其它脑神经症状），血压180/110mmHg（重度子痫前期收缩压≥160mmHg和（或）舒张压≥110mmHg）应考虑妊娠期高血压疾病，按其分期为重度子痫前期。重度子痫前期常有肾功能异常。慢性高血压和妊娠高血压疾病肾损害时均有血清肌酐值（E错）、尿素氮值（A错）、肌酸值（D错）、尿素值（B错）增高。尿酸值增高在慢性高血压患者中不显著，但在妊娠高血压疾病中显著增高，故鉴别二者最有价值的血液检查结果是尿酸值增高（C对）。